患儿，18个月。腹泻时轻时重，已经3个月，大便清稀无臭，夹不消化食物，有时便后脱肛，形寒肢冷，面色㿠白，精神委靡，睡时露睛，舌淡苔白，指纹色淡。治疗应首选
A. 异功散合平胃散
B. 附子理中汤合四神丸
C. 保和丸合二陈汤
D. 金匮肾气丸合人参乌梅汤
E. 参苓白术散合理中丸

正确答案：B。附子理中汤合四神丸

解析：据患儿以“腹泻三个月”为主症，故诊断为腹泻。患儿久泄不止，脾肾阳虚，命火不足，不能温煦脾土，故大便清稀无臭，夹不消化食物；脾虚气陷，则见脱肛；命门火衰，阳不温布，阴寒内生，故形寒肢冷，面色㿠白，精神委靡，睡时露睛；舌淡苔白，指纹色淡，皆为脾肾阳虚的见证，故其证候为脾肾阳虚证，当治以温补脾肾，固涩止泻，方药为附子理中汤和四神丸（B对）。异功散的功用为益气健脾，行气化滞，适用于脾胃气虚兼气滞证；平胃散的功用为燥湿运脾，行气和胃，适用于湿滞脾胃证（A错）。保和丸的功用为消食和胃，适应于伤食泻；二陈汤的功用为燥湿化痰，理气和中，适用于湿痰证（C错）。金匮肾气丸的功用为补肾助阳，适应于肾阳不足证；人参乌梅汤的功用为酸甘化阴，健脾止痢，适应于小儿泄泻之气阴两伤证（D错）。参苓白术散的功用为益气健脾，渗湿止泻，适应于脾虚泻；理中丸的功用为温中祛寒，补气健脾，适应于脾胃虚寒证、阳虚失血证或脾胃虚寒所致的胸痹（E错）。